四环素进入机体后，对骨组织亲和力大，服药后，龈沟液中的浓度比血液者高，其倍数为
A. 2倍
B. 2～4倍
C. 2～10倍
D. 4倍
E. 4～8倍

正确答案：C。2～10倍

解析：本题考查牙周病的全身药物治疗-四环素族药物。四环素进入机体后，对骨组织亲和力大，服药后，龈沟液中的浓度比血液者高，其倍数为2～10倍（C对）。四环素族药物为广谱抗生素，对C⁺菌、G⁻菌及螺旋体均有抑制其繁殖的作用。四环素族药物在体内分布广，可存在于多种组织、器官和体液中，尤其对骨组织亲和力强，在龈沟液中的浓度为血药浓度的2～10倍。牙周治疗中常用的四环素族药物有四环素、多西环素（又名强力霉素）、米诺环素（又名二甲胺四环素）。